气血两虚的病变多见于哪两脏
A. 心与肺
B. 心与肾
C. 心与脾
D. 脾与肝
E. 肺与肝

正确答案：C。心与脾

解析：心与脾的关系，主要表现在血液生成与运行方面的相互为用、相互协同（C对）。①血液生成：脾主运化而为气血生化之源，心主血脉，心生血养脾以维持其运化功能。若脾失健运，化源不足，可导致心失所养，劳神思虑过度，不仅暗耗心血，又可损伤脾气，形成心脾两虚证。②血液运行：血液在脉中正常运行，既有赖于心气的推动，又依靠脾气的统摄。临床上，若心气不足，行血无力；脾气虚损，统摄无权，均可导致血行失常，或见气虚血瘀，或见气不摄血的出血。心与肺的关系主要体现为气与血的关系，心与肺的病变相互影响，常表现为气血失和（A错）。心与肾的关系，主要表现为水火既济、精神互用、君相安位等方面（B错）。肝与脾的关系，主要表现在疏泄与运化的相互为用、藏血与统血的相互协调关系（D错）。肺与肝的关系，主要体现在调节人体气机升降方面（E错）。